西司他丁与亚胺培南配伍的主要目的是
A. 提高对β-内酰胺酶的稳定性
B. 降低亚胺培南的不良反应
C. 防止亚胺培南在肾中破坏
D. 延缓亚胺培南在肝脏代谢
E. 延缓亚胺培南耐药性产生

正确答案：C。防止亚胺培南在肾中破坏